移植抗原属于
A. 同种异型抗原
B. 异种抗原
C. 异嗜性抗原
D. 自身抗原
E. 独特型抗原

正确答案：A。同种异型抗原